X线片根尖周透射区包括多数牙时确诊病原牙的主要依据是患牙
A. 是否有牙周疾病
B. 有无窦道
C. 牙髓有无活力
D. 有无龋洞
E. 有无叩痛

正确答案：C。牙髓有无活力

解析：本题考查慢性根尖周炎的诊断要点。X线片根尖周透射区包括多数牙时确诊病原牙的主要依据是患牙牙髓有无活力（C对）。X线片显示根尖周透射区说明根尖部有骨质吸收，患牙为慢性根尖周炎，一般是由牙髓感染扩散至根尖周引起，此时牙髓已无活力，故牙髓有无活力是确诊病源牙的主要依据。X线片显示根尖周有透射影，则说明根尖有炎症存在，即根尖周透射区内的数牙都存在牙周疾病，故是否有牙周疾病（A错）不能成为确诊病源牙的主要依据。脓液会在薄弱的地方破溃而出形成窦道，包括数牙的脓肿区一般只有一个窦道，故有无窦道（B错）不能作为确诊病原牙的主要依据。有龋洞可以继发牙髓炎症和根尖周病，但与慢性根尖周炎并无直接联系，故有无龋洞（D错）不能成为确诊病源牙的主要依据。根尖有透射影的牙都存在叩痛，故有无叩痛（E错）不能成为确诊病源牙的主要依据。